2％利多卡因局部注射麻醉一次注射量不得超过
A. 5ml
B. 10ml
C. 15ml
D. 20ml
E. 25ml

正确答案：D。20ml

解析：本题考查局麻药-利多卡因。利多卡因是口腔治疗中常见的局麻药，可用于表面麻醉或阻滞麻醉，常用浓度为2%，一次注射量不得超过20ml（D对），若过量可能导致中毒反应。